男，55岁。慢性乙型肝炎病史15年，肝区隐痛2个月。腹部B超提示肝后叶直径约2cm的低回声结节。对诊断最有意义的实验室检查是
A. 碱性磷酸酶
B. 癌胚抗原
C. Y-谷胺酰转移酶
D. 甲胎蛋白
E. CA199

正确答案：D。甲胎蛋白

解析：患者为中年男性，有慢性乙型肝炎病史多年（原发性肝癌多见于病毒性肝炎后期恶变），肝区隐痛2个月（肝癌临床常见症状），腹部B超提示肝后叶低回声结节（肝癌病灶）。结合上述病史、临床表现和实验室检查，原发性肝癌可能性大，对诊断最有意义的实验室检查是甲胎蛋白（D对），甲胎蛋白是诊断肝细胞癌的特异性标志物。碱性磷酸酶（A错）、γ-谷胺酰转移酶（C错）有助于AFP阴性肝癌的诊断；癌胚抗原（B错）是一种广谱性肿瘤标志物，主要用于大肠癌、乳腺癌、肺癌等的诊断；CA19-9（E错）即糖链抗原199，在胰腺癌、肝胆和胃肠道疾病时可明显升高，目前临床上主要作为胰腺癌的首选肿瘤标志物。